下列哪种是死疫苗
A. BCG
B. 小儿麻痹糖丸
C. 麻疹疫苗
D. 鼠疫疫苗
E. 伤寒疫苗

正确答案：E。伤寒疫苗